一婴儿突发惊厥，无热，反复发作3次，惊厥后意志清，活泼如常，患儿为人工喂养，极少户外活动，未服鱼肝油，查体：出牙延迟，哈氏沟明显，方颅，血钙1.0mmol/L，最确切的诊断为
A. 佝偻病早期
B. 佝偻病的活动期
C. 维生素缺乏性手足搐溺症
D. 低血糖症
E. 低血镁症

正确答案：C。维生素缺乏性手足搐溺症

解析：该患儿为人工喂养，极少户外活动，未服鱼肝油，提示维生素D摄入缺乏，结合患儿“突发惊厥，无热，反复发作3次，惊厥后意志清，活泼如常”的临床症状、查体，且血钙1.0mmol/L，为低血钙症，可诊断为维生素D缺乏性手足搐溺症（C对）——维生素D缺乏性手足搐搦症是由于维生素D缺少而甲状旁腺又不能代偿，以致血中钙离子降低，神经肌肉兴奋性增高，以突发无热惊厥，手足搐搦或喉痉挛等为主症，呈反复发作，发作后神志清醒。佝偻病早期（A错）主要表现为神经兴奋性增高，如有烦躁、睡眠不安、易惊、夜啼、多汗等症，并可致枕部脱发而见枕秃；血生化改变轻微，血清（OH）D3下降，血钙正常或略下降，血磷降低，碱性磷酸酶正常或稍高，骨骼X线摄片可无异常，或见临时钙化带稍模糊。佝偻病的活动期（B错），又叫激期，主要表现为骨骺变化和运动机能发育迟缓。低血糖症（D错）常发生于清晨空腹时，有进食不足或腹泻病史，一般口服或静脉注射葡萄糖液后抽搐立即停止，血糖常<2.2mmol/L，血钙正常。低血镁症（E错）多见于新生儿，或牛乳喂养的小婴儿，常同时合并低钙血症，可出现烦躁、惊跳、阵发性屏气、甚至惊厥，血清镁常<0.58mmol/L（1.4mg/dl），本病例未提供血镁值，故暂不考虑本病。